在医患交往的过程中，医护人员不恰当的交往方式是
A. 用专业术语进行交流
B. 重视患者的自我感受
C. 关注疾病本身和相关话题
D. 采取封闭和开放式的提问
E. 了解患者的安全需要

正确答案：A。用专业术语进行交流

解析：本题考查医患的交往方式。在医患交往的过程中，医护人员不恰当的交往方式是用专业术语进行交流（A错，为本题的正确答案）。在医患交往的过程中，医护人员恰当的交往方式是重视患者的自我感受（B对）；关注疾病本身和相关话题（C对）；采取封闭和开放式的提问（D对）；了解患者的安全需要（E对）；医护人员不应用专业术语与患者进行交流。